关于有机磷中毒叙述错误的是
A. 经一定的潜伏期方出现相应的临床症状
B. 表现为毒蕈碱样症状、烟碱样症状、中枢神经系统症状
C. 按临床中毒症状表现可分为三级：轻度、中度、重度
D. 轻度中毒血胆碱酯酶活力降至50%～70%，重度中毒会降至30%以下
E. 应用大剂量硫酸阿托品注射，是为了促进胆碱酯酶复活和乙酰胆碱的分解

正确答案：E。应用大剂量硫酸阿托品注射，是为了促进胆碱酯酶复活和乙酰胆碱的分解

解析：本题考查有机磷中毒解救。关于有机磷中毒叙述错误的是应用大剂量硫酸阿托品注射，是为了促进胆碱酯酶复活和乙酰胆碱的分解（E错，为本题正确答案）。阿托品不能破坏磷酸酯类物质，也不能使受到抑制的胆碱酣酶恢复活力或分解体内蓄积的乙酰胆碱，更不能用来预防有机磷中毒。它的作用仅在于能拮抗乙酰胆碱的毒蕈碱样作用，提高机体对乙酰胆碱的耐受性。有机磷农药急性中毒后，经一定的潜伏期即开始相应的临床症状（A对）。有机磷中毒所出现的症状大致可分为毒蕈碱样症状、烟碱样症状及中枢神经系统症状三大症候群（B对）。有机磷中毒按照临床表现可分为三级：轻度中毒、中度中毒、重度中毒（C对）。（1）轻度中毒：头痛、头晕、恶心、呕吐、乏力、多汗、胸闷、腹痛、视力障碍等。血胆碱酯酶活力降至50%～70%。（2）中度中毒：上述症状更加明显，精神恍惚、言语不清、流涎、肌肉颤动、瞳孔缩小，肺部有湿啰音。血胆碱酯酶活力降至30%～50%。（3）重度中毒：昏迷、惊厥、抽搐、呼吸困难、瞳孔极度缩小、口唇发绀、脉搏细速、血压下降，有肺水肿。血胆碱酯酶活力降至30%以下（D对）。